广义的卫生系统包括以下哪几方面
A. 资金、信息和知识
B. 医疗产品和技术
C. 卫生人力和服务提供
D. 全面指导和管理
E. 以上均包括

正确答案：E。以上均包括

解析：广义的卫生系统由资金、信息和知识、医疗产品和技术、卫生人力和服务提供、运输工具、通信以及全面指导和管理所组成。掌握“卫生系统及功能”知识点。